用于室上性心动过速的药物是
A. 地高辛
B. 奎尼丁
C. 两者皆有效
D. 两者皆无效

正确答案：C。两者皆有效

解析：本题考查用于室上性心动过速的药物。地高辛和奎尼丁（C对）可用于治疗室上性心动过速。地高辛为强心苷类正性肌力药，可用于心房扑动引起的快速心室率，室上性心动过速。奎尼丁为钠通道阻滞，可用于室上性及室性心动过速。